全身粟粒性结核病常常是肺结核经哪种途径播散的结果
A. 淋巴道
B. 血道
C. 支气管
D. 潜伏的病菌重新繁殖
E. 沿组织间隙蔓延

正确答案：B。血道

解析：全身粟粒性结核病常常是肺结核经血道（B对）播散的结果。淋巴道（A错）是原发性肺结核的常见播散途径。支气管（C错）是继发性肺结核的常见播散途径。潜伏的病菌重新繁殖（D错）是引起继发性肺结核病的原因。沿组织间隙蔓延（E错）在结核病中少见。